胸膜斑是以下哪种尘肺的病理特点
A. 矽肺
B. 煤肺
C. 石棉肺
D. 石墨尘肺
E. 以上全部

正确答案：C。石棉肺

解析：本题考查石棉肺的病变特点。石棉肺（C对）的特点是会造成肺间质弥漫性纤维化，同时形成石棉小体（特有），脏层胸膜肥厚，壁层胸膜会形成胸膜斑。煤斑，又称煤尘灶，是煤工尘肺最常见的原发性特征性病变，是病理诊断的基础指标（A错）。煤肺病人胸片主要以小型类圆形阴影为多见（B错）。石墨尘肺只会产生肺部弥漫性纤维化为主的全身疾病现象，不会产生胸膜斑（DE错）。